下列药材伪品中，含二苯乙烯苷类物质，新折断面在紫外光灯下显蓝紫色荧光的是
A. 半夏伪品鞭檐犁头尖的块茎
B. 人参伪品商陆的根
C. 天麻伪品马铃薯的块茎
D. 柴胡伪品大叶柴胡的根茎
E. 大黄伪品河套大黄的根及根茎

正确答案：E。大黄伪品河套大黄的根及根茎

解析：本题考查的是大黄伪品鉴别。下列药材伪品中，含二苯乙烯苷类物质，新折断面在紫外光灯下显蓝紫色荧光的是大黄伪品河套大黄的根及根茎（E对）。